女、17岁。近1个月来话多，情绪高涨，喜欢购物，少眠，称自己是中央领导的女儿，自己能做大事，头脑聪明，好管闲事，爱打抱不平，做事虎头蛇尾。该患者诊断为
A. 焦虑症
B. 强迫症
C. 精神分裂症
D. 躁狂症
E. 分离转换障碍

正确答案：D。躁狂症

解析：17岁女性，近1个月来话多，情绪高涨（情感高涨是躁狂发作的典型表现），喜欢购物，少眠（睡眠需求减少是躁狂发作的特征之一），称自己是中央领导的女儿，自己能做大事（提示有夸大观念及妄想），头脑聪明，好管闲事，爱打抱不平，做事虎头蛇尾（活动增多的症状）。综上考虑诊断为躁狂症（D对）。焦虑症（A错）主要表现为无明确客观对象的紧张担心，坐立不安，还有植物神经功能失调症状，如心悸、手抖、出汗、尿频等，及运动性不安。强迫症（B错）的特点为有意识的强迫和反强迫并存，一些毫无意义、甚至违背自己意愿的想法或冲动反反复复侵入患者的日常生活。患者虽体验到这些想法或冲动是来源于自身，极力抵抗，但始终无法控制。精神分裂（C错）的常见的阳性症状是幻想、妄想及语言和行为的紊乱，阴性症状是正常心理功能的缺失，涉及情感、社交及认知方面的缺陷。分离转换障碍（E错）主要表现为解离性（精神障碍）和转换性（躯体障碍）两种障碍，解离症状又称为癔症性精神症状，是指患者部分或完全丧失对自我身份的识别和对过去的记忆，而表现为意识范围缩小、选择性遗忘或精神暴发等，转换症状又称为癔症性躯体症状，是指患者将遭遇无法解决的问题和冲突时所产生的不快，以各种各样躯体症状的方式表现出来。